髋关节后脱位的典型畸形是髋关节
A. 屈曲、内收、内旋
B. 屈曲、内收、外旋
C. 屈曲、外展、内旋
D. 屈曲、外展、外旋
E. 屈曲、外旋

正确答案：A。屈曲、内收、内旋

解析：髋关节后脱位多发生于交通事故，发生事故时，病人的体位处于屈膝及髋关节屈曲内收，股骨则有轻度的内旋，股骨头从髋关节囊的后下部薄弱区脱出后即可形成髋关节屈曲、内收、内旋的典型畸形（A对）。屈曲、外展、外旋为髋关节前脱位的典型畸形（D错）。屈曲、外旋见于股骨颈骨折（E错）。屈曲、内收、外旋（B错）和屈曲、外展、内旋（C错）不是关节脱位的典型畸形。